糖皮质激素本身没有收缩血管的效应，但能加强去甲肾上腺素的缩血管作用，这称为
A. 协同作用
B. 致敏作用
C. 增强作用
D. 允许作用
E. 辅助作用

正确答案：D。允许作用